主要用于测量在疾病和治疗影响下行为改变和角色功能表现的量表是
A. QWB评价量表
B. 疾病影响量表（SIP）
C. 健康调查量表（SF-36）
D. 癌症患者生活功能指标量表（FLIC）
E. 欧洲生存质量测定量表（EQ-5D）

正确答案：B。疾病影响量表（SIP）